在体内不易蓄积，适用于老年和肾功能不全患者的胰岛素促泌剂类降糖药是
A. 艾塞那肽
B. 利拉鲁肽
C. 西格列汀
D. 罗格列酮
E. 瑞格列奈

正确答案：E。瑞格列奈

解析：本题考查瑞格列奈。在体内不易蓄积，适用于老年和肾功能不全患者的胰岛素促泌剂类降糖药是瑞格列奈（E对）。艾塞那肽（A错）容易出现胃肠道不适。利拉鲁肽（B错）适用于成人2型糖尿病患者控制血糖，不良反应有恶心、腹泻、呕吐、便秘、腹痛、消化不良、头痛和上呼吸道感染等。西格列汀（C错）用于改善2型糖尿病患者的血糖控制，不良反应有过敏反应、血管性水肿、皮疹、荨麻疹、皮肤血管炎以及剥脱性皮肤损害等。罗格列酮（D错）为胰岛素增敏剂，常见的不良反应为贫血、血红蛋白降低、血容量增加、血细胞比容降低、血红蛋白降低等。